人参归脾丸既能益气补血，又能
A. 健脾养心
B. 升阳举陷
C. 疏肝和胃
D. 益气健脾
E. 温补气血

正确答案：A。健脾养心

解析：本题考查的是人参归脾丸的功能。人参归脾丸既能益气补血，又能健脾养心（A对）。人参归脾丸【功能】益气补血，健脾宁心。刺五加【功效】补气健脾，益肾强腰，养心（A错）安神，活血通络。补中益气丸【功能】补中益气，升阳举陷（B错）。小柴胡颗粒【功能】解表散热，疏肝和胃（C错）。香砂六君丸【功能】益气健脾（D错），和胃。人参养荣丸【功能】温补气血（E错）。